便秘通的功能是
A. 润肠通便
B. 泻火通便
C. 理气通便
D. 健脾益气，润肠通便
E. 燥湿健脾，润肠通便

正确答案：D。健脾益气，润肠通便

解析：本题考查的是便秘通的功能。便秘通的功能是健脾益气，润肠通便（D对）。便秘通：【功能】健脾益气，润肠通便。麻仁丸：【功能】润肠通便（A错）。当归龙荟丸：【功能】泻火通便（B错）。通便宁片：【功能】宽中理气，泻下通便（C错）。